按一级动力学消除的药物的特点是
A. 药物的半衰期随剂量而改变
B. 并非为大多数药物的消除方式
C. 单位时间内实际消除的药量递减
D. 酶学中的米-曼公式与动力学公式相似
E. 以固定的间隔给药，体内血药浓度难以达到稳态

正确答案：C。单位时间内实际消除的药量递减